不属于椎骨间连结的是
A. 关节盘
B. 椎间盘
C. 前纵韧带
D. 后纵韧带
E. 无

正确答案：A。关节盘

解析：椎骨间连结分为椎体间连结和椎弓间连结。椎体间连结有椎间盘（B对）、前纵韧带（C对）、后纵韧带（D对）。关节盘（A错，为本题正确答案）是位于关节囊内，可用来减少外力对关节的冲击和震荡，不属于椎骨间连结。